小儿五脏娇嫩，最突出表现在
A. 肝、脾、肾
B. 肺、脾、肾
C. 心、肝、肾
D. 脾、心、肝
E. 心、肝、肺

正确答案：B。肺、脾、肾

解析：从脏腑娇嫩的具体内容来看，五脏六腑的形和气皆属于不足，其中尤以肺、脾、肾三脏更为突出，故曰小儿“肺常不足”、“脾常不足”及“肾常虚”。肺主气，司呼吸，主宣发肃降，开窍于鼻，外合皮毛。小儿肺常不足主要表现为呼吸不匀，息数较促；腠理不密，卫外不固，易为外邪所犯，引发感冒、咳嗽、肺炎、哮喘等肺系疾病。脾主运化，为后天之本，小儿脾常不足主要表现为：脾胃的运化功能较弱；脾胃功能相对不足。肾为先天之本，主藏精，主水，主纳气。“肾气”的生发是推动小儿生长发育、脏腑功能成熟的根本动力。随着小儿年龄的不断增长，至女子“二七”左右、男子“二八”左右才能逐渐成熟完善起来。小儿肾常不足主要表现为：小儿肾主生长发育的功能尚不足；小儿肾主生殖繁衍的功能不足；小儿肾主二便的功能不足，故小儿五脏娇嫩，最突出表现在肺、脾、肾三脏（B对）。